胎龄已足月，但出生体重＜2500g的新生儿指的是
A. 小于胎龄儿
B. 适于胎龄儿
C. 大于胎龄儿
D. 足月小样儿
E. 早期新生儿

正确答案：D。足月小样儿